男，40岁，干部。近1个月出现情绪低落，对工作及娱乐圈没有兴趣，卧床多，不思饮食，入睡困难，早醒，有轻生想法。经过上述所选择药物治疗2周后，患者的症状逐渐加重，表现为卧床不动，不说话，并有严重的自杀企图，此时宜选择的治疗措施是
A. 非典型抗精神病药
B. 电抽搐治疗
C. SSRIs+碳酸锂
D. 三环类抗抑郁药+碳酸锂
E. 舒必利

正确答案：B。电抽搐治疗

解析：该中年男性，近1个月以情绪低落为主要表现，对工作及娱乐圈没有兴趣，卧床多，不思饮食（食欲下降），入睡困难、早醒（睡眠障碍），有轻生想法（自杀观念），故诊断为抑郁发作，患者经药物治疗2周后，症状逐渐加重，表现为卧床不动，不说话，并有严重的自杀企图，应首选电抽搐治疗（B对）。